克罗米通乳膏用于治疗
A. 寻常痤疮
B. 疥疮
C. 体、股癣
D. 蛲虫感染
E. 带状疱疹

正确答案：B。疥疮

解析：本题考查克罗米通。克罗米通乳膏用于治疗疥疮（B对）、皮肤瘙痒。局部应用的治疗疥疮药包括林旦乳膏、克罗米通、苯甲酸苄酯、硫黄软膏。寻常痤疮（A错）可用过氧苯甲酰、维A酸、阿达帕林等治疗。体、股癣（C错）主要是浅部真菌感染引起的，常用的有咪康唑、联苯苄唑、益康唑和克霉唑等。蛲虫感染（D错）可用哌嗪治疗。带状疱疹（E错）可用阿昔洛韦治疗。